毛果芸香碱滴眼后，对视力的影响是
A. 视近物清楚，视远物模糊
B. 视近物模糊，视远物清楚
C. 视近物、远物均清楚
D. 视近物、远物均模糊
E. 视物基本无改变

正确答案：A。视近物清楚，视远物模糊